女性，60岁，直肠癌手术后病理报告：中分化腺癌，5.8cm×4.2cm×3cm大小，侵及阴道后壁，肠系膜淋巴结3/7，查见转移癌，该病人Dukes分期应为
A. B1期
B. B2期
C. C1期
D. C2期
E. D期

正确答案：E。D期

解析：患者老年女性，直肠癌，查见转移癌，为M1，只要具有M1均为D期（E对）。